确诊宫外孕未破裂型，最可靠的辅助方法是
A. 妇科内诊，基础体温测定
B. 阴道后穹隆穿刺，基础体温测定
C. 基础体温测定，HCG测定
D. 尿妊娠试验，基础体温测定
E. B超检查，尿妊娠试验

正确答案：E。B超检查，尿妊娠试验

解析：早孕诊断最可靠的辅助方法是基础体温测定、HCG测定。宫外孕（未破裂型）诊断最可靠的辅助方法是B超检查、尿妊娠试验（E对）。